外科常用手术疗法挂线法的适应证是
A. 痈肿
B. 丹毒
C. 疮疖
D. 瘘管
E. 以上均不是

正确答案：D。瘘管

解析：挂线法的机理为利用挂线的紧箍作用，促使气血阻绝，肌肉坏死，最终达到切开的目的。其适应证：用于疮疡溃后脓水不净，经内服、外敷等治疗无效而形成瘘管（D对）或窦道者；或疮口过深或生于血络丛处而不宜采用切开手术者。